男，35岁，动物园的鸟类饲养员。发热咳嗽伴头痛、眼痛1周。查体：T40℃，眼结膜充血，双肺可闻及湿啰音。血常规正常，胸部X线片示间质性肺炎。其感染的病原体最可能是
A. 肺炎支原体
B. 腺病毒
C. 肺炎链球菌
D. 呼吸道合胞病毒
E. 肺炎衣原体

正确答案：E。肺炎衣原体

解析：中年男性患者，发热咳嗽伴头痛、眼痛1周。查体：T40℃，眼结膜充血，双肺可闻及湿啰音。血常规正常，胸部X线片示间质性肺炎。综合患者的症状、体征和辅助检查，初步诊断为肺炎衣原体肺炎（E对）。肺炎支原体（A错）的典型表现是持久的阵发性剧咳。腺病毒（B错）、呼吸道合胞病毒（D错）起病较急。肺炎链球菌（C错）胸部X线片表现为大片炎症浸润阴影或实变影。